女，29岁。外阴瘙痒伴分泌物增多3天。妇科检查：外阴及阴道黏膜充血，阴道内大量豆渣状分泌物。正确的处理是
A. 常规阴道冲洗
B. 克林霉素治疗
C. 抗真菌治疗
D. 甲硝唑治疗
E. 雌激素治疗

正确答案：C。抗真菌治疗

解析：患者外阴瘙痒伴分泌物增多3天（外阴阴道假丝酵母菌病的主要表现为外阴瘙痒、灼痛伴阴道分泌物增多），妇检见外阴及阴道黏膜充血，阴道内大量豆渣状分泌物（分泌物特征为白色稠厚呈凝乳或豆腐渣样，妇检可见外阴及阴道黏膜红肿、小阴唇内侧及阴道黏膜附有白色块状物），故首先考虑为外阴阴道假丝酵母菌病。治疗可根据患者情况选择局部或全身应用抗真菌药物（C对）。常规阴道冲洗（A错）为阴道炎的一般性治疗，或用于妇科或手术前的阴道准备。克林霉素治疗（B错）及甲硝唑治疗（D错）为细菌性阴道病的治疗方法（P252）。雌激素治疗（P252）（E错）多用于萎缩性阴道炎。